下列属于单糖的是
A. 蔗糖
B. 乳糖
C. 半乳糖
D. 海藻糖
E. 水苏糖

正确答案：C。半乳糖